关于淋巴结的描述，错误的是
A. 一侧隆凸一侧凹陷，凹陷处为淋巴结门
B. 输出管与凹侧相连
C. 输出管数目多于输入管的数目
D. 常聚集成群
E. 多沿血管周围配布

正确答案：C。输出管数目多于输入管的数目

解析：淋巴结一侧凸隆一侧凹陷，凹陷处为淋巴结门（A对），有输出管与之相连（B对）。因为一个淋巴结的输出淋巴管可以成为另一个淋巴结的输入淋巴管，所以不存在输出管数目多于输入管的说法（C错，为本题正确答案）。淋巴结常聚集成群（D对），且多沿血管周围配布（E对）。